急性阑尾炎常见的典型临床表现
A. 阵发性右下腹痛
B. 腰大肌试验阳性
C. 发热
D. 转移性腹痛
E. 恶心、呕吐

正确答案：D。转移性腹痛

解析：急性阑尾炎最典型的临床表现就是转移性右下腹痛（D对），可见于约70%～80%的病人。阵发性右下腹痛（A错）可以见于急性阑尾炎、右侧输尿管结石等，无特异性。腰大肌试验（P372）阳性（B错）指病人左侧卧位，右大腿后伸时出现右下腹疼痛，提示阑尾位于腰大肌前方，仅见于部分患者。发热（C错）、恶心呕吐（E错）等为急性阑尾炎、急性化脓性腹膜炎等多种疾病的一般表现，无特异性。